根据药物不良反应的性质分类，药物产生毒性作用的原因是
A. 给药剂量过大
B. 药物效能较高
C. 药物效价较高
D. 药物选择性较低
E. 药物代谢较慢

正确答案：A。给药剂量过大

解析：本题考查药物产生毒性作用的原因。药物的毒性通常是在治疗疾病时（或者误服、自杀服用等）因给药剂量过大（A对）、用药时间过长或用药者为过敏体质、遗传异常时才会出现毒性作用；副作用是指使用治疗剂量的药物，出现与治疗目的无关的不适反应，产生的主要原因是药物的选择性较低（D错）；效能高（B错）、效价高（C错）、以及代谢慢（E错）不是药物产生毒性作用的原因。